滑膜或关节囊的急性炎症属于
A. 咀嚼肌紊乱疾病类
B. 关节结构紊乱疾病类
C. 炎性疾病类
D. 骨关节疾病类
E. 骨关节炎

正确答案：C。炎性疾病类

解析：炎性疾病类此类疾病不是指由细菌引起的感染性疾病，而是指由各种原因造成的过大开口或外伤，引起滑膜或关节囊的急性炎症；也可由（牙合）因素等引起滑膜或关节囊的慢性炎症；关节结构紊乱、骨关节病也可继发或并发滑膜炎。掌握“颞下颌关节紊乱”知识点。